属于雌激素调节剂的抗肿瘤药是
A. 伊马替尼
B. 他莫昔芬
C. 氨鲁米特
D. 氟他胺
E. 紫杉醇

正确答案：B。他莫昔芬

解析：本题考查雌激素调节剂。他莫昔芬（B对）非固醇类的抗雌激素类药物，属于激素受体调节剂，与雌激素受体结合后抑制乳腺癌细胞的增殖，从而起到抗肿瘤治疗的目的；伊马替尼（A错）是高度特异性的酪氨酸激酶抑制剂,靶向治疗肿瘤；氨鲁米特（C错）用于抑制肾上腺皮质功能；氟他胺（D错）为非甾体类抗雄激素药物；紫杉醇（E错）从植物红豆杉的树皮中所提取的天然次生代谢产物,具有良好的抗肿瘤作用。